患者，男，32岁。急性发病、寒战、高热、咳嗽、胸痛。查体：右下肺语颤增强，叩诊呈浊音，听诊右下肺可闻及湿罗音。X线可见右下肺大片密切增高阴影。应首先考虑的是
A. 肺结核
B. 肺脓肿
C. 肺炎球菌肺炎
D. 肺不张
E. 右侧胸腔积液

正确答案：C。肺炎球菌肺炎

解析：急性发病、寒战、高热、咳嗽、胸痛。查体：右下肺语颤增强，叩诊呈浊音，听诊右下肺可闻及湿罗音。X线可见右下肺大片密度增高阴影，为感染链球菌后的肺炎球菌肺炎（C对）。肺结核（A错）的特点为咳嗽、咳痰，痰中带血或咯血，低热，乏力，消瘦，盗汗。肺脓肿（B错）的特点为高热，咳大量腥臭脓痰。肺不张（D错）的特点为胸闷，气急，呼吸困难，干咳。右侧胸腔积液（E错）的特点为呼吸困难，咳嗽，胸痛。